上皮内可见少数味蕾的是
A. 丝状乳头
B. 菌状乳头
C. 轮廓乳头
D. 叶状乳头
E. 味蕾

正确答案：B。菌状乳头

解析：菌状乳头：数目较少，分散于丝状乳头之间，有的菌状乳头的上皮内可见少数味蕾。掌握“口腔黏膜分类及组织结构”知识点。